根据《中华人民共和国药品管理法实施条例》，中药饮片的标签不须注明的内容是
A. 品名
B. 产地
C. 产品批号
D. 有效期限
E. 生产日期

正确答案：D。有效期限

解析：本题考查中药饮片生产管理。根据《中华人民共和国药品管理法实施条例》中药饮片的标签不须注明的内容是有效期限（D错，为本题正确答案）。中药饮片包装必须印有或贴有标签。中药饮片的标签必须注明品名（A对）、规格、产地（B对）、生产企业、产品批号（C对）、生产日期（E对）、实施批准文号管理的中药饮片还必须注明批准文号。